不属于霍乱患者泻吐期的临床特点的是
A. 多数以剧烈腹泻开始，继以呕吐
B. 多数腹泻伴有里急后重
C. 排便每日数次至10数次或无法计数
D. 粪便以黄水便或清水便为多
E. 粪便有鱼腥味，镜检无脓细胞

正确答案：B。多数腹泻伴有里急后重